循证医学所收集的证据中，质量最佳者为
A. 单个的大样本随机对照试验
B. 队列研究
C. 病例对照研究
D. 基于多个质量可靠的大样本随机对照试验所做的系统评价
E. 专家意见

正确答案：D。基于多个质量可靠的大样本随机对照试验所做的系统评价